男孩，3岁，自幼人工喂养，食欲极差，有时腹泻。身高85cm，体重7500g。皮肤干燥苍白，腹部皮下脂肪厚度约0.3cm。脉搏缓慢，心音较低钝。上述情况发生，除立即给氧外，首先应采取的措施为
A. 给予呼吸兴奋剂
B. 测血糖，静注高渗葡萄糖
C. 测血钙，静脉补充钙剂
D. 给予强心剂
E. 输液纠正脱水

正确答案：B。测血糖，静注高渗葡萄糖

解析：营养不良患儿出现低血糖时，应及时监测血糖，静注高渗葡萄糖（B对）或口服葡萄糖溶液。若不及时补充葡萄糖，患儿可因呼吸暂停而死亡。